最容易合并休克的骨折是
A. 肱骨骨折
B. 尺骨和桡骨骨折
C. 股骨骨折
D. 胫骨和腓骨骨折
E. 第二跖骨骨折

正确答案：C。股骨骨折

解析：骨折后休克的主要原因是出血，（P33）通常人体在迅速失血超过全身总血量的20%（800-1000ml）时，即出现休克。骨盆骨折、股骨骨折（C对）和多发性骨折，其出血量大者可达2000ml以上，故最容易并发休克。根据P630 图58-11可知，肱骨骨折（A错）出血量约为100-800ml；尺骨和桡骨骨折（B错）出血量大约为50-400ml；胫、腓骨骨折（D错）出血量大约为100-1000ml，可合并休克，但与股骨骨折出血量300-2000ml相比较，股骨骨折更容易合并休克。第二跖骨骨折出血量很少，基本不会造成休克（E错）。